乳牙患龋率高峰为
A. 4～8岁
B. 5～8岁
C. 6～8岁
D. 7～9岁
E. 10岁

正确答案：B。5～8岁

解析：学龄前儿童易患龋，乳牙萌出后不久即可患龋病，以后患病率逐渐增高，在3岁左右患龋率上升较快，至5～8岁乳牙患龋率达到高峰，6岁左右恒牙开始萌出，乳牙逐渐脱落，患龋率逐渐下降。掌握“龋病流行病学”知识点。